关于龋齿的病因，Keyes提出“三联因素论”，后来Newbrum又提出“四联因素论”。请问后者较前者多出的一个因素是
A. 细菌
B. 食物
C. 清洁牙齿的习惯
D. 宿主
E. 时间

正确答案：E。时间